流脑皮肤瘀点，瘀斑不断增加，考虑DIC，应及早应用的药物是
A. 青霉素
B. 甘露醇
C. 头孢菌素
D. 肾上腺皮质激素
E. 肝素

正确答案：E。肝素

解析：流脑考虑DIC时，应尽早使用肝素（E对），起到抗凝作用。青霉素（A错）、头孢菌素（C错）用于普通型流脑的治疗，对于缓解流脑引起的DIC症状无效。甘露醇（B错）用于流脑引起的脑水肿、脑疝的治疗。肾上腺皮质激素（D错）适用于流脑导致的毒血症明显的患者的治疗。